患者咳嗽气急，咳痰量多、质稠、色黄，胸胁胀痛，面赤身热，口干，舌红苔黄，脉滑数。治疗应首选
A. 泻白散合黛蛤散
B. 桑白皮汤
C. 桔梗汤
D. 清金化痰汤
E. 千金苇茎汤合犀黄丸

正确答案：D。清金化痰汤

解析：患者咳嗽气急可诊断为咳嗽。痰热郁肺，肺失宣降，故咳嗽喘息气粗，胸胁胀满，伴身热，口干。舌红，苔黄或黄腻，脉滑数为痰热郁肺之象，故诊断为痰热郁肺证。治疗此咳嗽应以清热化痰肃肺为法，处方应选清金化痰汤（D对）。泻白散合黛蛤散用于治疗肝火犯肺的咳嗽（A错）。桑白皮汤虽也有清化痰热之功，但多用其治疗痰热郁肺的喘证（B错）。桔梗汤排脓解毒，用于治疗肺痈（C错）。千金苇茎汤合犀黄丸清肺解毒，化瘀消痈用于治疗肺痈成痈期（E错）。